某人血浆中含有抗A、抗B凝集素，则此人的血型可能是
A. A1型
B. B型
C. AB型
D. A2型
E. O型

正确答案：E。O型

解析：红细胞表面凝集原本质是抗原，血清中凝集素的本质是抗体，不同血型的人的血清中含有不同的抗体，但不含与自身红细胞抗原相对应的抗体，以免发生抗原-抗体反应引起红细胞凝集。血浆中含有抗A、抗B凝集素，红细胞表面无A、B凝集原，该血型为O型（E对）。A1型（A错）血浆中只含抗B凝集素。B型（B错）血浆中只含抗A凝集素。AB型（C错）血浆中全无抗A和抗B凝集素。A2型（D错）血浆中含有抗B凝集素和抗A1凝集素。